头孢菌素类的作用机制是
A. 抑制细菌蛋白质合成
B. 抑制细菌细胞壁合成
C. 与PABA相竞争
D. 抑制二氢叶酸还原酶
E. 抑制DNA回旋酶

正确答案：B。抑制细菌细胞壁合成

解析：本题考查头孢菌素的作用机制。头孢菌素类的作用机制是抑制细菌细胞壁合成（B对）。氨基糖苷类药作用机制是抑制细菌蛋白质的合成（A错）。磺胺类药与对氨基苯甲酸（PABA）竞争（C错）二氢叶酸合成酶。甲氧苄啶的作用机制为抑制细菌二氢叶酸还原酶（D错）。氟喹诺酮类药的主要作用靶位在DNA回旋酶（E错），干扰DNA复制、转录和重组，从而影响DNA的合成而导致细菌死亡。